男，55岁。大量饮酒10余年，停止喝酒后2天，出现走路不稳、四肢震颤，看到床上有鱼、虾在跳，分不清方向，判断不了时间。头颅CT无异常。该患者最可能的诊断是
A. 癫痫所致精神障碍
B. 脑器质性精神障碍
C. 酒精性痴呆
D. 震颤谵妄
E. 精神分裂症

正确答案：D。震颤谵妄

解析：该患者有长期饮酒史，停止喝酒后2天，出现走路不稳、四肢震颤，看到床上有鱼、虾在跳（知觉异常），分不清方向，判断不了时间（定向力障碍）（D对）。酒精性痴呆患者长期、大量饮酒后出现的持续性智力减退，表现为短期、长期记忆障碍，抽象思维及理解判断障碍，人格改变，部分患者有皮层功能受损表现，本例无智力减退症状，且患者有长期饮酒突然断酒史，故不考虑（C错）。